高血压诊断性评估中用于危险分层标准一般不包括
A. 血压升高水平
B. 是否有影响预后的各种心血管危险因素
C. 是否存在靶器官损害
D. 是否存在脏器官损害
E. 是否存在相关的临床并发症情况

正确答案：D。是否存在脏器官损害

解析：对已明确诊断的高血压病患者作诊断性评估，以便进行危险分层。用于危险分层标准一般包括4个内容：①血压升高水平；②是否有影响预后的各种心血管危险因素；③是否存在靶器官损害；④是否存在相关的临床并发症情况。诊断性评估所需要的信息主要来自患者的病史、家族史、体格检查和实验室检查。掌握“原发性高血压”知识点。